心理性的应激可引起
A. 生理性体温升高
B. 病理性体温升高
C. 两者均可
D. 两者均无
E. 无

正确答案：A。生理性体温升高

解析：体温升高分为生理性体温升高（月经前期、剧烈运动、心理性应激等）（A对）和病理性体温升高（发热和过热）。